关于生物监测，正确的说法是
A. 目的是为了发现生物标志物
B. 生物监测可以代表经呼吸道接触量
C. 生物监测不能反应机体总的接触量和负荷
D. 生物监测可用于筛检易感者
E. 生物效应剂量是表示吸收到体内毒物的量

正确答案：D。生物监测可用于筛检易感者

解析：本题考查生物监测的相关内容。生物标志物是指反映生物系统与外源性化学物、外源性物理因素和生物因素之间相互作用的任何可测定指标，而不是监测目的（A错）；环境监测可以代表外接触量，特别是经呼吸道的接触量（B错）。生物监测可以反映机体总的接触量和负荷（C错），表示吸收到体内毒物的量是内剂量（E错）。生物监测可用于筛检易感者（D对）。